引起Ⅰ型呼吸衰竭最常见的疾病是
A. 慢性支气管炎
B. 阻塞性肺气肿
C. 气管异物
D. 膈肌麻痹
E. ARDS

正确答案：E。ARDS

解析：呼吸衰竭按照动脉血气分析分为Ⅰ型呼吸衰竭和Ⅱ型呼吸衰竭。Ⅰ型呼吸衰竭即缺氧性呼吸衰竭，主要见于肺换气障碍疾病，如严重肺部感染性疾病、间质性肺疾病、急性肺栓塞、ARDS等（E对）。Ⅱ型呼吸衰竭主要见于通气功能障碍疾病，如慢性阻塞性肺疾病（COPD）（B错）、支气管哮喘、呼吸肌麻痹（D错）和气管异物慢性支气管炎（A错）在没有发展到慢阻肺的阶段时，很少引起呼吸衰竭，主要表现就是咳嗽、咳痰。